女，40岁。肥胖、高血压、闭经2年。查体：BP160/90mmHg，向心性肥胖、脸圆、多血质外貌，腹部可见宽大紫纹。血糖11.8mmol/l。该患者最可能的诊断是
A. 库欣综合征
B. 糖尿病
C. 代谢综合征
D. 肥胖症
E. 高血压

正确答案：A。库欣综合征

解析：中年女性患者，主要症状：肥胖、高血压、闭经。体征：BP160/90mmHg，向心性肥胖、脸圆。多血质外貌，腹部可见宽大紫纹。患者最可能的诊断是库欣综合征（A对）。库欣综合征为各种病因造成肾上腺分泌过多糖皮质激素（主要是皮质醇）所致病症的总称，典型病例的表现：①向心性肥胖、满月脸、多血质外貌；②肌无力，下蹲后起立困难；③皮肤表现：皮肤薄，微血管脆性增加，轻微损伤即可引起瘀斑；④心血管表现：高血压常见，与肾素-血管紧张素系统激活，对血管活性物质加压反应增强，血管舒张系统受抑制及皮质醇可作用于盐皮质激素受体等因素有关；⑤对感染抵抗力减弱；⑥性功能障碍；⑦代谢障碍：糖耐量减低，部分患者出现类固醇性糖尿病，与本患者症状相符。患者血糖升高，有类固醇性糖尿病的可能性，但仅为库欣综合征的继发性代谢障碍表现之一，不能诊断为糖尿病（B错），糖尿病无向心性肥胖、满月脸及多血质、紫纹等皮肤表现。代谢综合征（C错）即以肥胖、高血压、糖代谢及血脂异常等为主要临床表现的症候群（P761），无向心性肥胖、满月脸及多血质、紫纹等皮肤表现。肥胖症（D错）可有高血压，但不会出现满月脸及多血质、紫纹等皮肤表现。高血压（E错）一般指原发性高血压，本例患者出现的高血压为继发于皮质醇增高引起，高血压一般无向心性肥胖、满月脸及多血质、紫纹等皮肤表现。